急症患者临床用药宜选用的中药速效剂型有
A. 吸入气雾剂
B. 舌下片
C. 丸剂
D. 注射剂
E. 滴丸（水溶性基质）

正确答案：A、B、D、E。吸入气雾剂；舌下片；注射剂；滴丸（水溶性基质）